对诊断心肌梗死最有意义的是
A. 淀粉酶
B. 血清转氨酶
C. Y-谷氨酰基转肽酶
D. 血清碱性磷酸酶
E. 肌酸磷酸激酶

正确答案：E。肌酸磷酸激酶

解析：肌酸磷酸激酶是早期诊断急性心肌梗塞的一项敏感指标，尤其肌酸磷酸激酶CK-MB在起病后4小时内增高，故肌酸磷酸激酶（E对）对诊断心肌梗死最有意义的。淀粉酶（A错）主要用于诊断急性胰腺炎。血清转氨酶（B错）可用诊断于各种肝病、心肌梗塞早期、肝细胞坏死变性、肝硬化、肝癌等。Y-谷氨酰基转肽酶（C错）可用于诊断原发性或转移性肝癌、胆道感染、肝硬化、心肌梗塞等。血清碱性磷酸酶（D错）主要来自肝和骨骼，主要用于诊断肝胆和骨骼系统疾病。